既息风止痉，又清热平肝的药是
A. 天麻
B. 蜈蚣
C. 刺蒺藜
D. 钩藤
E. 罗布麻叶

正确答案：D。钩藤

解析：本题考查的是钩藤的功效。既息风止痉，又清热平肝的药是钩藤（D对）。钩藤：【功效】息风止痉，清热平肝。天麻（A错）：【功效】息风止痉，平抑肝阳，祛风通络。蜈蚣（B错）：【功效】息风止痉，攻毒散结，通络止痛。刺蒺藜（C错）即蒺藜。蒺藜：【功效】平肝，疏肝，祛风明目，散风止痒。罗布麻叶（E错）：【功效】平肝清热，降血压，利水。